下列适合接种卡介苗的人群为
A. 免疫力低的人群
B. 既往感染过结核的患者
C. 结核菌素试验阳性
D. 结核菌素试验阴性
E. 严重结核病患者

正确答案：D。结核菌素试验阴性

解析：卡介苗是由减毒牛型结核杆菌悬浮液制成的活菌苗，有免疫缺陷或损害者（如艾滋病患者）有可能引起全身性卡介苗疾病的危险（A错）；既往感染过结核的患者、结核菌素试验阳性、严重结核病患者无需接种卡介苗（BCE错）。